下列关于小儿热量需要的叙述，正确的是
A. 按体重算，每日需要的量随年龄增加而增加
B. 生长越快，需要热量越多
C. 排泄所损失的热量占总热量的15%
D. 婴儿每日所需的总热量为418.6kJ/kg（100kcal/kg）
E. 小儿哭闹时，热量供应需要增加2倍

正确答案：B。生长越快，需要热量越多

解析：生长发育为小儿能量的特殊需要，生长发育越迅速，需要量越大，1岁以内婴儿增长最快，以后逐渐减少（B对）。小儿能量需要的总量相对比成人多，年龄越小，需要量相对也越大，不是随年龄增加而增加（A错）。食物中一部分未经消化吸收的食物随粪便排出体外，主要是脂肪和蛋白质，一般不超过食物所含热量的10%（C错）。1岁以内的婴儿每日所需的总热量为460kJ/kg（110kcal/kg）（D错）。多动好哭者比安静的小儿需要的能量可高出3～4倍（E错）。